在阿拉木图召开的初级卫生保健国际会议确定社区的定义，是在哪一年
A. 1967年
B. 1977年
C. 1987年
D. 1997年
E. 2007年

正确答案：C。1987年

解析：1987年在阿拉木图召开的初级卫生保健国际会议将社区定义为：以某种形式的社会组织或团体结合在一起的一群人。掌握“社区口腔卫生服务”知识点。